治疗顺铂化疗所引起的重度恶心呕吐，首选的联合用药方案是
A. 甲氧氯普胺联合维生素B₆
B. 西咪替丁联合维生素B₆
C. 多潘立酮联合地塞米松
D. 多潘立酮联合甲氧氯普胺
E. 阿瑞吡坦联合地塞米松

正确答案：E。阿瑞吡坦联合地塞米松

解析：本题考查药物的联合应用。治疗顺铂化疗所引起的重度恶心呕吐，首选的联合用药方案是阿瑞吡坦联合地塞米松（E对）。重度致吐性化疗药所引起恶心呕吐的治疗，每天化疗前，联合应用5-HT₄受体阻断剂、口服地塞米松12mg和阿瑞吡坦125mg。